肝硬化最常见的并发症是
A. 自发性腹膜炎
B. 肝性脑病
C. 门静脉血栓形成
D. 上消化道出血
E. 原发性肝癌

正确答案：D。上消化道出血

解析：自发性腹膜炎（A错），肝性脑病（B错），门静脉血栓形成（C错），原发性肝癌（E错）均是肝硬化的并发症，但与上消化道出血相比，并不是最常见的。